卡托普利治疗高血压的作用机制有
A. 抑制血管紧张素转换酶活性
B. 减少醛固酮分泌
C. 减少缓激肽水解
D. 抑制血管平滑肌增殖
E. 阻断血管紧张素AT₁受体

正确答案：A、B、C、D。抑制血管紧张素转换酶活性；减少醛固酮分泌；减少缓激肽水解；抑制血管平滑肌增殖

解析：本题考查卡托普利。卡托普利为血管紧张素转换酶抑制剂，作用于肾素-血管紧张素-醛固酮系统，抑制血管紧张素转换酶（ACE）的活性（A对），降低血管组织血管紧张素Ⅱ的含量与醛固酮的分泌（B对），抑制血管平滑肌增殖（D对）；同时卡托普利还能够抑制缓激肽的降解（C对）。卡托普利不能阻断血管紧张素Ⅱ与AT₁受体结合（E错）。